川贝母的主要药理作用有
A. 镇咳
B. 祛痰
C. 降血压
D. 升高血糖
E. 抗惊厥

正确答案：A、B、C。镇咳；祛痰；降血压

解析：本题考查的是川贝母的药理作用。川贝母的主要药理作用有镇咳（A对）、祛痰（B对）、降血压（C对）。川贝母的药理作用：贝母总生物碱及非生物碱部分，均有镇咳作用；川贝流浸膏，川贝母碱均有不同程度的祛痰作用。此外，西贝母碱还有解痉作用；川贝碱、西贝碱有降压作用；贝母碱能增加子宫张力；贝母总碱有抗溃疡作用。